男性，30岁，患病4周，以高热为主，曾确诊伤寒，日前体温开始下降，食欲好转，体力渐增，脾肿大开始回缩时，要特别重视
A. 加强营养
B. 增加活动
C. 限制饮食
D. 继用足量抗生素
E. 充足睡眠

正确答案：C。限制饮食

解析：患者确诊为伤寒，目前处于缓解期，本期小肠常处于溃疡期，容易出现肠出血肠穿孔等并发症，应特别重视限制饮食（C对），饮食应从稀粥、软质饮食逐渐过渡，退热后2周才能恢复正常饮食。加强营养（A错）、增加活动（B错）、继用足量抗生素（D错）、充足睡眠（E错）为一般支持治疗，无需特别重视。